具有下列哪项表现者，可诊断为重度铅中毒
A. 腹绞痛
B. 贫血
C. 铅麻痹
D. 中毒性周围神经病
E. 神经衰弱伴腹胀，便秘

正确答案：C。铅麻痹